下列哪项属于婚前检查保健指标
A. 妇女常见病筛查率
B. 妇女常见病患病率
C. 妇女常见病治愈率
D. 恶性肿瘤发病率
E. 检出疾病率

正确答案：E。检出疾病率

解析：本题考查婚前检查保健指标。婚前检查保健指标主要包括婚前医学检查率、检出疾病率（E对ABCD错）、婚前卫生指导率、婚前卫生咨询率等。